患者，女，26岁。产后第3天出现寒战，高热，腰痛，尿痛，下腹痛。检查：肾区叩击痛，耻骨上压痛，尿白细胞30个/高倍视野，尿蛋白（﹢），血白细胞18×10⁹/L，中性粒细胞0.86×10⁹/L。其诊断是
A. 败血症
B. 肾结核
C. 急性肾盂肾炎
D. 急性膀胱炎
E. 急性肾小球炎

正确答案：C。急性肾盂肾炎

解析：急性肾盂肾炎（C对）可见于任何年龄，育龄期妇女最多见，起病急骤，临床表现为发热、寒战、头痛、全身酸痛等，体温多在38度以上，多为弛张热，也可呈稽留热或间歇热。泌尿系症状有尿频、尿急、尿痛、排尿困难、下腹部疼痛、腰痛等，少数还有剧烈的腹部阵发性绞痛，沿输尿管向膀胱方向放射。腰痛程度不一，多为钝痛或酸痛。体检时在肋腰点（腰大肌外缘与第12肋交叉点）有压痛，肾区叩击痛。常规检查可见尿中有白细胞、血细胞、蛋白（ABDE错）。